属于影响行为的倾向因素的是
A. 态度
B. 资源
C. 政策
D. 法律
E. 责任

正确答案：A。态度

解析：影响行为的因素包括倾向因素、促成因素、强化因素。其中（1）倾向因素，又称前置因素，指能促进或阻碍人们行为改变动机的因素，包括：知识、态度（A对）、信念、价值观。（2）促成因素又称实现因素，指促成或阻碍健康行为动机得以实现的因素，包括实现健康行为所必须的技术、物质基础、社会力量等，如卫生机构的可及性、家庭收入、健康保险、政策、法律法规。（3）强化因素指目标人群在行为改变后所获得的各种正向或负向反馈，其对人们的健康行为起到激励行为维持与发展、强化行为，或削弱行为的作用。强化因素包括社会支持、同伴赞许、亲属肯定与鼓励、医务人员激励、个人感受等。